患者，男，67岁，诊断为骨性关节炎，既往有胃溃疡病史。宜选用的药物是
A. 双氯芬酸
B. 美洛昔康
C. 阿司匹林
D. 曲马多
E. 布洛芬

正确答案：B。美洛昔康

解析：本题考查美洛昔康。既往有胃溃疡病史，宜选用的药物是美洛昔康（B对）。如果骨性关节炎患者发生胃肠道不良反应的危险性较高，可使用非选择性NSAIDs加用抑酸药物（H₂受体阻断剂、质子泵抑制剂）或米索前列醇等胃黏膜保护剂，或应用选择性COX-2抑制剂。美洛昔康为选择性较高的COX-2抑制剂，在发挥抗炎作用的同时，胃肠道不良反应较小，用于类风湿关节炎的症状治疗、疼痛性骨关节炎（关节病、退行性骨关节病）的症状治疗。双氯芬酸（A错）为非选择性NSAIDs，用于各种急、慢性关节炎和软组织风湿所致的疼痛，以及创伤后、术后的疼痛、牙痛、头痛等，对成年人及儿童的发热有解热作用。使用时应注意消化道损害、肾损害及高血压，缓释剂型不可嚼碎服用。阿司匹林（C错）为环氧合酶（COX）的不可逆抑制剂，可以使COX发生乙酰化反应而失去活性，从而阻断前列腺素等内源性致热致炎物质的生物合成，起到解热、镇痛、抗炎的作用，另外还可以抑制血小板凝聚和防止血栓形成。由于对COX酶缺乏选择性，抑制了胃壁处的COX-1，造成胃壁处前列腺素合成减少，胃黏膜失去保护作用，引起消化道溃疡、出血等不良反应。曲马多（D错）为中枢性镇痛药，用于中、重度疼痛。曲马多的不良反应与其他阿片类药物相似，但胃部不适的发生率可能更高，还有癫痫发作风险。布洛芬（E错）为非选择性NSAIDs，具有抗炎、镇痛、解热作用，适用于治疗风湿性关节炎、类风湿关节炎、骨关节炎、强直性脊柱炎和神经炎等。不良反应最常见于胃肠系统，其发生率高达30%，从腹部不适到严重的出血或使消化性溃疡复发。